患者，女，23岁。被人发现时呈昏迷状态。查体：神志不清，两侧瞳孔呈针尖样大小，呼吸有大蒜臭味，应考虑的是
A. 安定中毒
B. 急性毒品中毒
C. 急性有机磷农药中毒
D. 亚硝酸盐中毒
E. 一氧化碳中毒

正确答案：C。急性有机磷农药中毒

解析：本例患者为青年女性，昏迷，查体可见神志不清、有针尖样瞳孔、呼出气体有蒜臭味，诊断首先考虑的是急性有机磷农药中毒（C对）。安定中毒（A错）主要表现为昏迷，也可有针尖样瞳孔，但呼出气体不会有蒜臭味。急性毒品中毒（B错）临床表现与毒品种类有关，如阿片类中毒可表现为昏迷、呼吸抑制和瞳孔缩小“三联征”。亚硝酸盐中毒（D错）主要表现为高铁血红蛋白血症，常出现发绀。一氧化碳中毒（E错）症状与血液中COHb浓度有密切关系，主要表现为头痛、头晕、恶心、呕吐、四肢无力、口唇黏膜可呈樱桃红色，严重者可出现昏迷、呼吸抑制、肺水肿。